哪种细胞的突起构成视神经
A. 视锥细胞
B. 视杆细胞
C. 双极细胞
D. 节细胞
E. 假单极神经元

正确答案：D。节细胞

解析：节细胞（D对）的轴突构成视神经。视锥细胞（A错）和视杆细胞（B错）是感光细胞，不参与构成视神经。双极细胞（C错）传递来自感光细胞的神经冲动，也不参与构成视神经。